女，42岁，反复低热、腰酸3年，夜尿增多6个月，曾多次尿培训有大肠杆菌，尿常规：蛋白1.1g/L，红细胞4~5/HP，哪项检查是确诊慢性肾盂肾炎较可靠的方法
A. 磁共振成像
B. 中段尿培养
C. 静脉肾盂造影
D. 尿素氮、肌酐检测
E. 肾CT扫描

正确答案：C。静脉肾盂造影